上颌骨的四突不包括
A. 额突
B. 颧突
C. 颞突
D. 腭突
E. 牙槽突

正确答案：C。颞突

解析：上颌骨的四突分别称为额突、颧突、腭突和牙槽突。颞骨左右成对，介于蝶骨、顶骨与枕骨之间，分为颞突、乳突、岩部和鼓板四部分，参与构成颅底及颅腔的侧壁。掌握“上颌骨解剖特点”知识点。